业务员纪某因身体不适去医院就诊，被初步诊断为疑似传染性非典型肺炎，并被实施单独隔离治疗。2天后，纪某厌倦了被隔治疗的状态，要求出院；医院反复劝说，不予批准。纪某于当晚溜出医院并回家；医院发现纪某失踪后立即向有关部门报告。家人得知纪某情况后动员其尽快返回医院接受隔离治疗，被纪某拒绝。纪某接受隔离治疗后又擅自脱离医院的角色行为属于
A. 角色行为冲突
B. 角色行为缺如
C. 角色行为强化
D. 角色行为减退
E. 角色行为异常

正确答案：D。角色行为减退

解析：角色行为减退（D对）是指个体承担病人角色后，因某种原因放弃了病人的角色并承担本应免除的其他社会角色的责任，如本题中患者纪某接受隔离治疗后又擅自脱离医院的行为。角色行为冲突（A错）则表现为个体在进入病人角色后因其集中了多种社会地位和多种角色，在其自身内部发生了多种角色的冲突。角色行为缺如（B错）表现为病人并没有进入病人的角色，并不承认自己患病。角色行为强化（C错）表现为躯体正在康复，但个体安于病人角色，其角色行为与躯体症状不相符，对自我表现过度忧虑，行为上表现出较强的退缩和依赖性。角色行为异常（E错）是病人无法承受患病带来的挫折和压力 ，对病人角色感到厌倦、悲观、绝望，由此导致行为异常。